下列哪一项是换药的适应证
A. 创口渗血较多或有大量分泌液溢出
B. 疑有血肿形成或感染
C. 敷料松脱
D. 伤口剧痛需要观察创口
E. 以上均是

正确答案：E。以上均是

解析：临床上一般在更换或去除引流物、创口渗血较多或有大量分泌液溢出、疑有血肿形成或感染、敷料松脱或过紧、伤口剧痛以及需要观察创口或皮瓣等情况时才进行换药。掌握“口外创口处理”知识点。